男，12岁。1个月前无明显诱因出现左胫骨近端肿痛，逐渐加重，皮肤表面静脉怒张，皮温增高。X线片见左胫骨近端呈溶骨性破坏，伴有骨膜日光放射表现。最适宜的治疗方法是
A. 刮除植骨
B. 对症治疗
C. 单纯截肢术
D. 放疗
E. 化疗+保肢治疗

正确答案：E。化疗+保肢治疗

解析：青少年男性患者，无明显诱因出现左胫骨近端肿痛，逐渐加重，皮肤表面静脉怒张，皮温增高（提示可能为肿瘤），X线片见左胫骨近端呈溶骨性破坏，伴有骨膜日光放射表现（骨肉瘤典型影像学表现），结合患者症状体征和影像学检查，该患者最可能的诊断为左胫骨骨肉瘤。骨肉瘤为恶性骨肿瘤，故应采用根治性切除瘤段、植入假体的保肢手术或截肢手术。由于骨肉瘤对化疗敏感，故术前术后均应行化学治疗（E对）。刮除植骨（A错）主要适用于良性骨肿瘤及瘤样病变。对症治疗（B错）为辅助治疗，仅能缓解症状，对于疾病进展无明显意义。单纯截肢术（C错）主要用于破坏广泛、其他辅助治疗无效的晚期患者。骨肉瘤对放疗（D错）不敏感。